痫病发作期宜选择下列哪组穴位
A. 印堂、神门、少府、太冲、阳陵泉
B. 关元、水沟、大陵、神门、中冲
C. 风池、百会、 太冲、行间、劳宫
D. 内关、水沟、百会、后溪、涌泉
E. 百会、素髎、行间、丰隆、后溪

正确答案：D。内关、水沟、百会、后溪、涌泉

解析：痫病发作期主穴、水沟、百会、后溪、涌泉、合谷、太冲、丰隆（D对）。